导致继发性腹膜炎的细菌一般是
A. 混合性细菌
B. 大肠杆菌
C. 变形杆菌
D. 厌氧菌
E. 肠球菌

正确答案：A。混合性细菌

解析：继发性腹膜炎是最常见的腹膜炎，一般是由混合性细菌（A对）感染所致。这些细菌主要是胃肠道内的常驻菌群，其中以大肠杆菌（B错）最为多见，其次为变形杆菌（C错）、厌氧菌（D错）、肠球菌（E错）等。